需要进行抢救的氟中毒剂量
A. 5mg/kg
B. 10mg/kg
C. 15mg/kg
D. 20mg/kg
E. 25mg/kg

正确答案：A。5mg/kg

解析：本题考查氟中毒需进行抢救的剂量。当氟摄入量达到或超过5mgF-/kg（A对B错）时，应立即急救，并住院观察。当氟摄入量接近或超过15mgF-/kg（CDE错）时，需立即进行紧急措施。